紫外线杀菌作用最强的波长范围是
A. 240～246nm
B. 246～250nm
C. 250～256nm
D. 265～266nm
E. 280～300nm

正确答案：D。265～266nm

解析：本题考查消毒与灭菌。紫外线杀菌的有效波长为240～280nm，其中以波长为265～266nm（D对）杀菌作用最强。